铅对卟啉代谢的作用，现以肯定具有抑制作用的酶主要是
A. δ-ALA合成酶及δ-ALAD
B. δ-ALA合成酶及血红素合成酶
C. δ-ALA合成酶及粪卟啉原氧化酶
D. δ-ALAD及血红素合成酶
E. δ-ALAD及粪卟啉原脱羟酶

正确答案：D。δ-ALAD及血红素合成酶

解析：本题考查铅中毒对机体酶的影响。当机体接触铅时，可抑制δ-氨基-γ-酮戊酸脱水酶活性和血红素合成酶（D对ABCE错）活性，表现为尿δ-氨基-γ-酮戊酸含量和血中锌原卟啉水平增加。因此尿δ-氨基-γ-酮戊酸和血红素合成酶的含量可作为反映毒作用的指标。